男，20岁，闭合性胸外伤5小时。查体：口唇发绀，端坐呼吸，左侧胸壁触及皮下气肿，气管右偏，左侧呼吸音消失。正确的急救措施是
A. 急诊开胸探查
B. 心包穿刺
C. 左胸腔穿刺排气
D. 加压吸氧
E. 气管插管

正确答案：C。左胸腔穿刺排气

解析：青年男性患者，查体见口唇发绀，端坐呼吸（提示有呼吸功能障碍），左侧胸壁触及皮下气肿（提示有气胸），气管右偏，左侧呼吸音消失（提示胸腔积气量大），结合患者病史和临床表现，应诊断为左侧张力性气胸。张力性气胸也称高压性气胸，是可迅速致死的急症，正确的急救措施是左胸腔穿刺排气（C对），使胸腔内高压气体迅速排出，改善患者症状。开胸探查（A错）主要用于持续漏气而肺难以膨胀患者的治疗。心包穿刺（B错）主要为心包填塞的急救措施。加压吸氧（D错）、气管插管（E错）主要用于稳定型小量气胸或首次发生的症状较轻的闭合性气胸的治疗。